口腔修复学中“临床检查”的内容包括
A. 口腔外部检查
B. 口腔内检查
C. X线检查
D. 模型检查
E. 以上都对

正确答案：E。以上都对

解析：口腔修复学临床检查的内容包括：临床一般检查（口腔外部检查、口腔内检查）、X线检查、模型检查。掌握“修复学临床检查”知识点。